关于休克的治疗原则，不正确的是
A. 失血性休克的治疗首先以输注平衡性溶液为主
B. 感染性休克的治疗，以处理原发感染灶抗感染治疗为主
C. 休克合并酸中毒时，不主张早期给予碱性药物纠酸
D. 在充分容量复苏的前提下可给予血管活性药物
E. 无论失血性休克或感染性休克，应首先纠正休克，再处理原发病

正确答案：B。感染性休克的治疗，以处理原发感染灶抗感染治疗为主

解析：感染性休克的治疗，首先是病因治疗，原则是在休克未纠正以前，应着重治疗休克，同时治疗感染；在休克纠正后，则应着重治疗感染（B错，为本题正确答案）。失血性休克的治疗，首先需要补充血容量，以输注平衡盐溶液为主（A对）。休克合并酸中毒时，按照血红蛋白氧合解离曲线的规律，碱过多使血红蛋白氧离曲线左移，氧不易从血红蛋白释出，可使组织缺氧加重，不主张早期给予碱性药物纠酸（C对）。休克治疗时在充分容量复苏的前提下可给予血管活性药物，以维持脏器灌注压，可迅速改善循环和升高血压（D对）。无论失血性休克或感染性休克，应首先纠正休克，再处理原发病（E对）。